男，35岁。淋雨后寒战、发热3天，胸透示右下肺炎，血WBC12.3×10⁹/L。该患者感染的病原菌最可能是
A. 肺炎链球菌
B. 结核分枝杆菌
C. 金黄色葡萄球菌
D. 流感嗜血杆菌
E. 铜绿假单胞菌

正确答案：A。肺炎链球菌

解析：患者为青年男性（为肺炎链球菌肺炎的好发年龄），淋雨后出现寒战、发热（为肺炎链球菌肺炎的典型表现），血WBC12.3×10⁹/L（正常为4～10×10⁹/L），提示存在感染，胸片示肺炎，根据其临床表现和实验室检查，考虑病原菌为肺炎链球菌（A对）。结核分枝杆菌（B错）多引起肺结核（P62），多表现为低热盗汗等结核中毒症状。金黄色葡萄球菌（C错）多引起急性化脓性炎症，如葡萄球菌肺炎（P47），毒血症状常很严重。流感嗜血杆菌（D错）引起的是坏死性肺炎。铜绿假单胞菌（E错）经常铜绿假单胞菌肺炎，咳蓝绿色痰为其特征。